用于苯胺中毒诊断
A. 血清碱性磷酸酶活性测定
B. 血中高铁血红蛋白含量测定
C. 全血胆碱脂酶活性测定
D. 血中碳氧血红蛋白含量测定
E. 尿中6-ALA含量测定

正确答案：B。血中高铁血红蛋白含量测定

解析：本题考察苯胺中毒诊断依据。当怀疑苯胺中毒时，应有明确的苯胺职业暴露史，出现相应的以高铁血红蛋白血症（B对ACDE错）为主的临床表现，并结合现场劳动卫生学调查，参考实验室检查结果（高铁血红蛋白增高、红细胞内赫恩滋小体、尿中对氨基酚增高），排除其他因素引起的类似疾病（如亚硝酸盐中毒），方可诊断为苯胺中毒。